运行于皮肤、分肉之间的精微物质是
A. 津
B. 液
C. 卫气
D. 宗气
E. 营气

正确答案：C。卫气

解析：本题考查的是气的分布。运行于皮肤、分肉之间的精微物质是卫气（C对）。卫气：与营气相对而言，卫气行于脉外而属阳，又称“卫阳”。卫气主要由水谷精气所化生，运行于脉外。卫气活动力特别强，流动迅速，故不受脉管的约束，可运行于皮肤、分肉之间，布散于全身内外上下。津（A错）：一般来说，质地较清稀，流动性较大，布散于体表皮肤、肌肉和孔窍，并能渗注于血脉，起滋润作用的，称为津。液（B错）：一般来说，质地较稠厚，流动性较小，灌注于骨节、脏腑、脑、髓等组织，起濡养作用的，则称为液。宗气（D错）：是积于胸中之气。宗气在胸中集聚之处，称作“气海”，又称“膻中”。宗气聚集于胸中，向上分布于肺与息道，向下贯注于心脉，布散全身。营气（E错）：又称“荣气”，与卫气相对而言，营气行于脉内而属阴，故又有“营阴”之称。营气运行于全身血脉之中，成为血液的重要组成部分。